粘固过程中有抑菌作用，在唾液中溶解度低释放氟的材料为
A. 磷酸锌粘固剂
B. 树脂类粘固剂
C. 聚羧酸粘固剂
D. 玻璃离子粘固剂
E. 氧化锌丁香油粘固剂

正确答案：D。玻璃离子粘固剂

解析：玻璃离子粘固剂：粘固强度与聚羧酸锌相当，粘固过程中有抑菌作用，在唾液中溶解度低，可以释放氟。掌握“修复体试戴、磨光与粘固”知识点。